下列各组疾病中均为乙类传染病的是
A. 流行性感冒，SARS
B. 黑热病，肺结核
C. 流行性出血热，疟疾
D. 鼠疫，狂犬病
E. 麻风病，伤寒

正确答案：C。流行性出血热，疟疾

解析：甲类传染病有两个：①鼠疫（D错）；②霍乱。SARS、流行性出血热、疟疾（C对）、伤寒（E错）、高致病性禽流感、狂犬病和炭疽属于乙类传染病，城镇6小时内上报，农村12小时内上报。流行性感冒（A错）、黑热病（B错）、麻风属于丙类传染病，发现后24小时内上报。需注意，乙类传染病中传染性非典型肺炎，炭疽中的肺炭疽，人感染高致病性禽流感，和脊髓灰质炎必须按甲类传染病采取报告控制措施。